对病例对照研究资料进行分层分析的目的是
A. 控制选择偏倚
B. 控制混杂偏倚
C. 控制信息偏倚
D. 提高分析效率
E. 提高资料的利用率

正确答案：B。控制混杂偏倚

解析：本题考查病例对照研究中控制混杂因素的方法。病例对照研究资料分析的中心内容是比较病例与对照中暴露的比例，并由此估计暴露与疾病之间是否有关联及其关联强度；也可进一步分析暴露与疾病的剂量反应关系等；可通过分层分析、多因素分析控制混杂偏倚（B对ACDE错）对研究结果的影响。